根据《中华人民共和国药品管理法》，属于假药的是
A. 未注明生产批号的药品
B. 未注明有效期的药品
C. 被污染的药品
D. 超过有效期的药品
E. 以他种药品冒充此种药品

正确答案：E。以他种药品冒充此种药品

解析：本题考查假药的界定。根据《中华人民共和国药品管理法》，属于假药的是以他种药品冒充此种药品（E对）。《中华人民共和国药品管理法》第九十八条规定，禁止生产（包括配制，下同）、销售、使用假药、劣药。有下列情形之一的，为假药：（一）药品所含成份与国家药品标准规定的成份不符；（二）以非药品冒充药品或者以他种药品冒充此种药品；（三）变质的药品；（四）药品所标明的适应症或者功能主治超出规定范围。有下列情形之一的药品，按假药论处：1.国务院药品监督管理部门规定禁止使用的；2.依照本法必须批准而未批准生产、进口或依照本法必须检验而未经检验即销售的；3.变质的；4.被污染的（C错）；5.使用依照本法必须取得批准文号而未取得批准文号的原料生产的；6.所标明的适应证或者功能主治超出规定范围的。有下列情形之一的药品，按劣药论处：1.未标明有效期或更改有效期的（B错）；2.不注明或更改生产批号的（A错）；3.超过有效期的（D错）；4.直接接触药品的包装材料和容器未经批准的；5.擅自添加着色剂、防腐剂、香料、矫味剂及辅料的；6.其他不符合药品标准规定的。